乳膏的加速试验的温度
A. 90℃±2℃
B. 75℃±2℃
C. 60℃±2℃
D. 45℃±2℃
E. 30℃±2℃

正确答案：E。30℃±2℃

解析：本题考查加速试验的方法。乳膏的加速试验的温度30℃±2℃（E对）。常规试验法：取市售包装的制剂3批，在温度40℃±2℃、相对湿度75%±5%的条件下放置6个月。在试验期间第1个月、2个月、3个月、6个月末分别取样一次，按照稳定性重点考察项目检测。在上述条件下，如6个月供试品经检测不符合质量标准相关规定，则应在中间条件（30℃±2℃、相对湿度65%±5%）下进行加速试验，时间仍为6个月。